不参与肝蒂组成的是
A. 肝的神经
B. 肝固有动脉
C. 肝静脉
D. 肝的淋巴管
E. 胆总管

正确答案：C。肝静脉

解析：肝的神经(A对)、肝固有动脉(B对)左右支、肝的淋巴管(D对)、胆总管(E对)(由肝左右管汇合形成)均参与构成肝蒂，而肝静脉(C错，为本题正确答案)参与构成第2肝门。